医患双方都具有独立人格，要求医师做到
A. 不伤害患者
B. 从各方面关心患者
C. “患者是上帝”
D. 平等对待患者
E. 关心患者心理需求

正确答案：D。平等对待患者